属于从治的是
A. 治热以寒
B. 寒者热之
C. 阳病治阴
D. 用热远热
E. 以通治通

正确答案：E。以通治通

解析：从治法，是指顺从病证的外在假象而治的一种治疗原则，又叫反治法，适用于疾病的征象与其本质不完全吻合的病证，具体包括：热因热用（用热性药物来治疗具有假热征象的病证，即以热治热）、寒因寒用（用寒性药物来治疗具有假寒征象的病证，即以寒治寒）、通因通用（用通利的药物来治疗具有通泻症状的实证，即以通治通）（E对）、塞因塞用（用补益药物来治疗具有闭塞不通症状的虚证，即以补开塞）。